下列组合哪项正确
A. 急性淋巴细胞白血病-儿童病例绿色瘤常见
B. 急粒白血病-特异性皮肤损害多见
C. M3-多伴DIC
D. 慢淋白血病-多见急变
E. 慢粒白血病-多伴中枢神经系统白血病

正确答案：C。M3-多伴DIC

解析：急性髓系白血病可伴绿色瘤，急性单核细胞白血病特异性皮肤损害多见，急性淋巴细胞白血病多见中枢神经系统白血病，慢性淋巴细胞白血病，起病缓慢，多无自觉症状。掌握“急性白血病”知识点。